《中国药典》规定，中药材及饮片的检查项目有
A. 杂质
B. 水分
C. 灰分
D. 有关物质
E. 重金属及有害元素

正确答案：A、B、C、E。杂质；水分；灰分；重金属及有害元素

解析：本题考查的是中药材及饮片的检查项目。《中国药典》规定，中药材及饮片的检查项目有杂质（A对）、水分（B对）、总灰分（C对）与重金属及有害元素（E对）。中药的纯度与中药质量密切相关，常影响中药质量的优劣程度和临床用药剂量的准确性。《中国药典》中与纯度相关的检查主要包括杂质检查、水分测定、干燥失重、灰分测定、色度检查、酸败度测定等，并已成为中药质量评价中的常规检查项。重金属及有害元素检查包括：①重金属检查：矿物药如石膏、芒硝含重金属不得过10mg/kg，玄明粉不得过20mg/kg；动物药如地龙含重金属不得过30mg/kg；银杏叶提取物、黄芩提取物、连翘提取物含重金属不得过20mg/kg等。②砷盐检查：《中国药典》规定玄明粉含砷盐不得过20mg/kg，芒硝含砷盐不得过10mg/kg，石膏含砷盐不得过2mg/kg。③铅、镉、砷、汞、铜测定：《中国药典》采用原子吸收分光光度法（第一法）和电感耦合等离子体质谱法（第二法）测定中药中铅、镉、砷、汞、铜的含量，并规定甘草、黄芪、丹参、白芍、西洋参、金银花、枸杞子、山楂、阿胶、牡蛎、珍珠、蛤壳等含铅不得过5mg/kg，镉不得过0.3mg/kg，砷不得过2mg/kg，汞不得过0.2mg/kg，铜不得过20mg/kg。海螵蛸含铅不得过5mg/kg，镉不得过5mg/kg，砷不得过10mg/kg，汞不得过0.2mg/kg，铜不得过20mg/kg。中药注射剂需要检查有关物质（D错）残留量等。